男，24岁。间断心悸1月余。心悸时心电图示：窦性心律，可见提前出现的宽大畸形的QRS波群，QRS时限0.16s，其前无P波，代偿间期完全正常。期前收缩后代偿间期形成的生理学机制是
A. 房-室延搁
B. 心肌传导速度不均一
C. 自律细胞兴奋性增加
D. 心内兴奋传导途径多变
E. 心肌有效不应期长

正确答案：E。心肌有效不应期长

解析：窦性心律，可见提前出现的宽大畸形的QRS波群，QRS时限0.16s，诊断为室性期前收缩。室性期前收缩有自己的不应期，当紧接在期前兴奋后的一次冲动由窦房结传到心室落在其不应期内时，则不能引起心室的兴奋和收缩，即为一次“脱失”，需等下一次窦房结的兴奋传来时才能引起兴奋和收缩，这样，在期前收缩之后会出现一段较长的心室舒张期，称为代偿间歇。因此期前收缩后代偿间歇形成的生理学机制是心肌有效不应期长（E对）。房-室延搁（A错）使心房肌的兴奋不能过快地传到心室肌，从而保证心房内血液在心室收缩前排入心室，有利于心室的充盈和射血（P108）。心肌传导速度不均一（B错）及心内兴奋传导途径不变（D错）与心室传导性有关，自律细胞兴奋性增加（E错）将导致心率加快，三者均与期前收缩后代偿间期形成无关。